女性，21岁学生，不慎溺水后2小时出现呼吸困难急诊入院。查体：BP90/60mmHg，R40次/分，P120次/分。烦躁不安，唇发绀，双肺可闻及湿啰音，胸片示双肺呈大片状浸润阴影。为明确诊断，该患者首选的检查是
A. 心电图
B. 脑部CT
C. 血气分析
D. 超声心动图
E. 心肌损伤标志物

正确答案：C。血气分析

解析：患者年轻女性，有溺水史（是急性呼吸窘迫综合征的常见危险因素），出现有呼吸困难，查体有血压下降，呼吸及心率增快，口唇发绀，两肺有湿啰音，胸片有大片状浸润阴影，根据其临床表现和体征，考虑诊断为急性呼吸窘迫综合症，首选的检查为血气分析（C对），其中PaO₂/FiO₂≤300mmHg是诊断ARDS的必要条件。心电图（A错）主要用来诊断心血管疾病，尤其是心律失常的诊断。脑部CT（B错）对诊断脑出血，脑梗塞及脑部占位性病变有意义。超声心动图（D错）主要用来诊断心脏瓣膜病及先天性心脏病。心肌损伤标志物（E错）主要诊断心肌梗死等疾病（这些检查均不能分析肺功能、明确ARDS的诊断）。